患者男性，45岁，消化性溃疡反复发作20年，近1个月来出现食欲减退，上腹部饱胀及沉重感，呕吐频繁，呕吐量大且含有酸臭味的宿食，呕吐物中不含胆汁，吐后上腹饱胀减轻，腹痛消失，明显消瘦，可见到上腹部的胃蠕动波，胃型，胃震水声，应诊断为
A. 消化性溃疡合并幽门梗阻
B. 肠梗阻
C. 贲门梗阻
D. 弥漫性腹膜炎
E. 食管癌

正确答案：A。消化性溃疡合并幽门梗阻

解析：患者男性，45岁，消化性溃疡反复发作20年，本次发病合并消化性溃疡。近1个月来出现食欲减退，上腹部饱胀及沉重感，呕吐频繁，呕吐量大且含有酸臭味的宿食，呕吐物中不含胆汁，吐后上腹饱胀减轻，腹痛消失，明显消瘦诊断为幽门梗阻，查体可见到上腹部的胃蠕动波胃型胃震水声（A对）。肠梗阻临床表现为腹痛、呕吐、腹胀、停止排气排便（B错）。贲门梗阻主要是因为一些疾病导致的食管下段肌张力增大，导致贲门处出现梗阻或者狭窄，或者血管部位的肿瘤导致梗阻出现恶心呕吐甚至不能饮食（C错）。弥漫性腹膜炎主要临床表现为腹痛、腹部压痛腹肌紧张，以及恶心，呕吐，发烧，白血球升高，严重时可致血压下降和全身中毒性反应（D错）。食管癌典型的症状为进行性咽下困难，先是难咽干的食物，继而是半流质食物，最后水和唾液也不能咽下（E错）。